目前认为与鼻咽癌发病有关的病毒是
A. 鼻病毒
B. HSV
C. EBV
D. CMV
E. 脊髓灰质炎病毒

正确答案：C。EBV

解析：由EBV感染引起或与EBV感染有关的疾病主要有4种：①传染性单核细胞增多症；②非洲儿童恶性淋巴瘤即Burkitt淋巴瘤；③鼻咽癌；④淋巴增生性疾病，如AIDS患者极易机会性感染EBV，导致弥漫性多克隆淋巴瘤等并可致死。掌握“疱疹病毒”知识点。